香薷散的功用是
A. 祛暑解表，化湿和中
B. 祛暑解表，清热化湿
C. 清暑解热，化气利湿
D. 清暑化湿，理气和中
E. 祛暑化湿，健脾和中

正确答案：A。祛暑解表，化湿和中

解析：该题考查香薷散的功用。香薷散为祛暑方剂，主治，因夏月乘凉饮冷，感受寒湿所致的阴暑。功能祛暑解表，化湿和中（A对）（BCDE错）。